急性缺血性脑卒中发作，应用溶栓药治疗时间窗是在发病后
A. 3小时内
B. 8小时内
C. 12小时内
D. 24小时内
E. 48小时内

正确答案：A。3小时内

解析：本题考查阿替普酶。阿替普酶给药时间窗为发病后3h内（A对）。